舌乳头炎包括
A. 丝状乳头炎
B. 菌状乳头炎
C. 叶状乳头炎
D. 轮廓乳头炎
E. 以上均包括

正确答案：E。以上均包括

解析：舌乳头炎包括丝状乳头炎、菌状乳头炎、叶状乳头炎及轮廓乳头炎。掌握“地图舌、沟纹舌及舌乳头炎”知识点。